一般而言，Ⅱ相反应对代谢的影响以及其中甲基化结合和乙酰化结合主要作用为
A. 使代谢活化；增加毒物水溶性
B. 使代谢活化；增加毒物脂溶性
C. 使代谢解毒；增加毒物水溶性
D. 使代谢解毒；增加毒物脂溶性

正确答案：B。使代谢活化；增加毒物脂溶性

解析：本题考查Ⅱ相反应的相关内容。Ⅱ相反应即结合反应，包括葡萄糖醛酸化、硫酸化、乙酰化、甲基化、与谷胱甘肽结合及与氨基酸结合。一般而言，Ⅱ相反应对代谢的影响以及其中甲基化结合和乙酰化结合主要作用为使代谢活化；增加毒物脂溶性（B对ACD错）。